诊断胃食管酸反流最适用的辅助检查是
A. 食管酸滴注试验
B. 食管压力测定
C. 胸部X线片
D. 胃镜及活检
E. 24小时食管pH监测

正确答案：E。24小时食管pH监测

解析：24小时食管pH监测（E对）可提供食管是否存在过度酸反流的客观证据，是诊断胃食管酸反流最适用的辅助检查。食管酸滴注试验（A错）是通过使食管黏膜酸化来诱发患者的烧心，胸痛症状，以确定症状是否与酸敏感有关。食管压力测定（P348）（B错）是反映食管下括约肌功能的指标，当反流性食管炎内科治疗效果不好时，可作为辅助诊断。胸部X线片（C错）不用于胃食管酸反流的检查。胃镜（D错）是诊断反流性食管炎最准确的方法，对无食管黏膜糜烂、溃疡的胃食管酸反流无诊断意义。